先天性腹股沟斜疝发生的最主要原因是
A. 腹横肌发育不全
B. 腹横筋膜发育不全
C. 腹外斜肌发育不全
D. 腹内斜肌发育不全
E. 腹膜鞘突不闭锁

正确答案：E。腹膜鞘突不闭锁

解析：先天性腹股沟斜疝发生的最主要原因是腹膜鞘突不闭锁（E对）或闭锁不完全。鞘突为胚胎时期，腹膜随睾丸下降至阴囊内形成的结构，鞘突下段在婴儿出生后不久成为睾丸固有鞘膜，其余部分自行萎缩闭锁。如鞘突不闭锁或闭锁不完全，就容易发生先天性腹股沟斜疝。腹横肌发育不全（A错）、腹横筋膜发育不全（B错）、腹内斜肌发育不全（D错）是后天性腹股沟斜疝发生的主要原因。腹外斜肌发育不全（C错）不是腹股沟疝发生的原因。